能够增强靶组织对胰岛素敏感性的药物是
A. 胰岛素
B. 磺脲类口服降糖药
C. 双胍类口服降糖药
D. α-葡萄糖苷酶抑制剂
E. 噻唑烷二酮类药物

正确答案：E。噻唑烷二酮类药物

解析：本题考查降糖药。噻唑烷二酮类（E对）药物能明显增强机体组织对胰岛素的敏感性，改善胰岛β细胞功能。胰岛素（A错）能促进组织摄取和利用葡萄糖，抑制肝糖原分解及糖异生作用，促进蛋白质和脂肪合成。磺脲类（B错）降糖药能够刺激胰岛素的分泌。双胍类降糖药（C错）抑制肝糖元异生，减少葡萄糖的来源，增强组织对葡萄糖的摄取和利用。α-葡萄糖苷酶抑制剂（D错）竞争性抑制位于小肠的各种α-葡萄糖苷酶，使淀粉类分解为葡萄糖的速度减慢，从而减缓肠道内葡萄糖的吸收。